开展以医院为基础的病例对照研究，最常见的偏倚是
A. 入院率偏倚
B. 不依从偏倚
C. 回忆偏倚
D. 失访偏倚
E. 现患病例-新发病例偏倚

正确答案：A。入院率偏倚

解析：由于利用医院病人作为病例和对照，病人对医院，医院对病人都有选择性，病例不是全体病人的随机样本，因此选择开展以医院为基础的病例对照研究，易产生入院率偏倚（A对）。现患病例还存在患病后改变了原有的某些暴露情况，从而导致因素与疾病关系的误差称为现患病例-新发病例偏倚（E错）。回忆偏倚（C错）是指在病例对照研究、回顾性队列研究中、研究对象回忆不真实所造成的偏倚：失访偏倚（D错）常常是由于观察时间过长，而出现的数据追踪丢失造成的偏倚。不依从偏倚（B错）的说法不规范。